反映病因与疾病联系强度的最好指标是
A. 潜伏期
B. 总人口的疾病发病期
C. 致病因子的流行率
D. 特意危险度
E. 相对危险度

正确答案：E。相对危险度

解析：本题考查相对危险度。反映病因与疾病联系强度的最好指标是相对危险度（E对ABCD错）。相对危险度是暴露组的危险度（测量指标是累积发病率）与对照组的危险度之比。